患者腰膝酸软乏力，失眠多梦，心悸健忘。治疗宜选用
A. 麦冬
B. 百合
C. 龟甲
D. 续断
E. 巴戟天

正确答案：C。龟甲

解析：患者腰膝酸软乏力，治以滋补肾阴，健骨；失眠多梦，心悸健忘，治以养血补心，安神定志。龟甲具有滋阴潜阳，益肾健骨，养血补心的功效（C对）。麦冬具有养阴润肺，益胃生津，清心除烦的功效，没有益肾健骨，养血补心的功效（A错）。百合具有养阴润肺，清心安神的功效，没有益肾健骨，养血补心的功效（B错）。续断具有补益肝肾，强筋健骨，止血安胎，疗伤续折的功效，没有养血补心的功效（D错）。巴戟天具有补肾助阳，祛风除湿的功效，没有养血补心之功（E错）。